生命伦理学的涵义是
A. 根据道德价值和原则，对生命科学和卫生保健领域内的人类行为进行系统研究的科学
B. 是医学伦理学不同历史条件下的不同表现形式
C. 生命伦理学研究的主要内容围绕着生命与死亡，包括生与死的控制问题
D. 是传统医学伦理学的继承和发展
E. 以上都对

正确答案：E。以上都对

解析：生命伦理学是根据道德价值和原则对生命科学和卫生保健领域内的人类行为进行系统研究的学科。主要研究生物医学和行为研究中的道德问题、环境与人口中的道德问题、动物实验和植物保护中的道德问题，以及人类生殖、生育控制、遗传、优生、死亡、安乐死、器官移植等方面的道德问题（E对）。